悬空式桥体与黏膜的关系是
A. 与黏膜面状接触
B. 离开黏膜1mm
C. 离开黏膜2mm
D. 离开黏膜3mm
E. 离开黏膜3mm以上

正确答案：E。离开黏膜3mm以上

解析：此种桥体的龈面与牙槽嵴顶的粘膜不接触，且留出至少3mm以上的空间，便于食物通过而不聚集，自洁作用良好，又称卫生桥。掌握“固定桥的设计”知识点。